以下哪项不是职业性噪声聋的诊断原则
A. 有明确的职业噪声接触史3年以上
B. 排除其他致聋原因
C. 纯音测定为感音性耳聋
D. 暴露噪声强度超过职业接触限值
E. 听力损失为低频下降型

正确答案：E。听力损失为低频下降型